女，35岁。因尿频、尿急、尿痛2天就诊。体检：体温38.5℃，右肾区叩痛明显，尿常规蛋白（++），白细胞满视野，红细胞10～15个/HP。此时最可能的诊断是
A. 急性膀胱炎
B. 急性肾盂肾炎
C. 急性间质性肾炎
D. 尿道综合征
E. 慢性肾盂肾炎

正确答案：B。急性肾盂肾炎

解析：青年女性，出现尿频、尿急、尿痛症状（典型膀胱刺激症状），体温38.5℃（急性肾盂肾炎时常有发热，体温多在38.0℃以上）、右肾区叩击痛（提示肾脏病变），尿常规蛋白（++）（正常尿蛋白阴性），白细胞满视野（正常0～5个/HP，患者存在白细胞尿，提示有尿路感染），红细胞10～15个/HP（存在镜下血尿，正常0～3个/HP），综合该患者的病史、体查、实验室检查，该患者诊断考虑为急性肾盂肾炎（B对）。急性膀胱炎（P493）（A错）常以膀胱刺激征为突出表现，包括尿频、尿急、尿痛、排尿不适等，一般少有发热（体温常不超过38.0℃）、腰痛。急性间质性肾炎（P488）（C错）常由药物引起，多伴有全身过敏表现（发热、皮疹、外周血嗜酸性粒细胞增多），可见肾功能受损（少尿或非少尿性急性肾衰竭）。尿道综合征（P495）（D错）有尿路刺激症状，其特点为多次检查无真性细菌尿，一般不伴发热，亦无肾区叩击痛。慢性肾盂肾炎（P493）（E错）病程常超过半年，多数患者有急性肾盂肾炎病史，后有不同程度的低热，尿频、排尿不适、腰部酸痛呈间歇性，症状常较急性期轻且不典型，可伴夜尿增多、低比重尿等肾小管功能受损表现。